位于延髓的核团是
A. 上橄榄核
B. 上泌涎核
C. 面神经核
D. 疑核
E. 无

正确答案：D。疑核

解析：疑核（D对）位于延髓内；上橄榄核（A错）脑桥中下部的脑桥被盖部的腹侧；上泌涎核（B错）位于脑桥下部，面神经核尾侧部附近的网状结构内；面神经核（C错）脑桥下部网状结构的腹外侧。